大结节性肝硬化最常见的病因是
A. 慢性酒精中毒
B. 心力衰竭
C. 病毒性肝炎
D. 日本血吸虫病
E. 以上均不是

正确答案：C。病毒性肝炎